受理申请医师注册的卫生行政部门对不符合条件不予注册的，应当自收到申请之日起多少日内给予申请人书面答复，并说明理由
A. 15 日
B. 20 日
C. 30 日
D. 40 日
E. 45 日

正确答案：B。20 日

解析：受理申请的卫生健康主管部门对不予注册的，应当自受理申请之日起二十个工作日内（B对）书面通知申请人和其所在医疗卫生机构，并说明理由。申请人如有异议的，可以依法申请行政复议或者向人民法院提起行政诉讼。